右心室流出道是
A. 左心室窦部
B. 右心室窦部
C. 动脉圆锥
D. 主动脉前庭
E. 腔静脉窦

正确答案：C。动脉圆锥

解析：动脉圆锥（C对）为右心室流出道，又称漏斗部。